男性，56岁。突然头晕，呕吐8小时。体检：两眼向右水平震颤，指鼻和跟膝胫右侧不稳，颈轻度抵抗。血压150/90mmHg。临床诊断为
A. 右大脑基底节区出血
B. 左大脑基底节区出血
C. 右小脑半球出血
D. 左小脑半球出血
E. 蛛网膜下腔出血

正确答案：C。右小脑半球出血